银汞合金修复时，牙颈部洞一般应有
A. 粘接固位
B. 潜凹固位
C. 鸠尾固位
D. 钉固位

正确答案：B。潜凹固位

解析：本题考查银汞合金充填术。银汞合金修复时，牙颈部洞应在颊舌和（或）龈壁与轴壁相交的线角作潜凹固位（B对），防止邻面部分在水平分力作用下向邻方移位。银汞合金没有粘结性，主要靠窝洞的机械固位（A错）。鸠尾固位位于（牙合）面防止充填体水平移位（C错）。一般将固位钉放在牙体组织较厚且相对强壮的区域，牙颈部牙体组织薄弱，该处不宜作钉固位形（D错）。